女，66岁。因剧烈胸痛5小时入院治疗。心电图示窦性心律，心率55次/分，Ⅱ、Ⅲ、aVF导联ST段抬高0.3mV，其余导联ST段正常。介入治疗前植入临时起搏器起搏心室，以60次/分频率起搏时，监测动脉血压由100/70mmHg降低至85/60mmHg。导致这种血压变化的最可能原因是
A. 起搏心律时阻力血管扩张致血压下降
B. 合并右心室梗死，右室排血减少致左室充盈减少
C. 起搏心律时心率增快，舒张期缩短导致回心血量减少
D. 起搏心律时心肌收缩力较弱致心排血量降低
E. 起搏时减少心房收缩对心室的充盈作用，左室充盈减少

正确答案：A。起搏心律时阻力血管扩张致血压下降

解析：66岁女性患者，因剧烈胸痛5小时入院治疗，心电图示窦性心律，心率55次分，Ⅱ、Ⅲ、aVF导联ST段抬高0.3mV，其余导联ST段正常（提示下壁心肌梗死合并三度房室传导阻滞）。介入治疗前植入临时起搏器起搏心室（该患者为下壁心梗合并三度房室传导阻，起搏方式为VVI），以60次/分频率起搏时，监测动脉血压由100/70mmHg降低至85/60mmHg。这种血压变化最可能的原因，与起搏心律时外周血管阻力降低致血压下降（A对E错）有关系，和起搏时减少心房收缩对心室的充盈作用，左室充盈减少无关。合并右心室梗死，右室排血减少致左室充盈减少（B错）是该患者原有的症状，与起搏器无直接关系，未装临时起搏器前血压仅100/70mmHg，已有所下降。该患者起搏器以60次/分频率起搏，不存在起搏心率增快导致的舒张期缩短（C错）。临时起搏器起搏对心肌收缩力是正性作用而非负性作用（D错）。